女，78岁。反复胸痛1周，加重2天。症状发作与活动无关，刚发病时，胸痛伴血压升高，就诊当日胸痛伴血压降低，呼吸困难不能平卧。心电图示V1～V6导联ST段压低0.5mV。实验室检查：cTnI30.5ng/ml。以下治疗原则正确的是
A. 症状稳定2周后介入评估
B. 2小时内进行介入评估
C. 不能进行介入评估
D. 72小时内进行介入评估
E. 24小时内进行介入评估

正确答案：B。2小时内进行介入评估

解析：患者老年女性，反复胸痛1周，症状发作与活动无关。症状加重两天，刚发病时，胸痛伴血压升高，就诊当日胸痛伴血压降低（表明患者血流动力学不稳定），呼吸困难不能平卧（左心衰表现）。心电图示V1～V6导联ST段压低0.5mV（严重冠状动脉疾病的表现，可能会发生急性心肌梗死或猝死）。实验室检查：cTnI30.5ng/ml，提示为肌钙蛋白增高（非ST段抬高型心肌梗死的表现）。结合患者临床表现、心电图及实验室检查，最可能的诊断为非ST段抬高型心肌梗死（NSTEMI）。患者发病后血流动力学不稳定，并出现严重左心衰症状，需在有条件的情况下2h内进行介入评估（B对）。